某男，75岁，患中风1年，左侧肢软无力，手足浮肿，语言謇涩，面色少华。舌体不正，舌质淡紫，边有痧斑，舌苔薄白，脉细涩无力。中医治法是
A. 行气活血
B. 益气养血
C. 滋肾利窍
D. 祛风涤痰
E. 平肝潜阳

正确答案：B。益气养血

解析：本题考查的是中风的辨证论治。患中风1年，左侧肢软无力，手足浮肿，语言謇涩，面色少华。舌体不正，舌质淡紫，边有痧斑，舌苔薄白，脉细涩无力。中医治法是益气养血（B对）。中风是以猝然昏仆，不省人事，半身不遂，口眼㖞斜，语言不利为主症的疾病。病轻者可无昏仆而仅见半身不遂和口眼㖞斜等症状。西医学的急性脑血管疾病，如脑梗死、脑出血、短暂性脑缺血发作和蛛网膜下腔出血等有上述表现者，可参考此内容辨证论治。（一）风痰入络证：【症状】肌肤不仁，手足麻木，突然发生口眼斜，语言不利，口角流涎，舌强语謇，甚则半身不遂，或兼见手足拘挛，关节酸痛等症。舌苔薄白，脉浮数。【治法】祛风化痰通络（D错）。（二）风阳上扰证：【症状】平素头晕头痛，耳鸣目眩，突然发生口眼斜，舌强语謇，或手足重滞，甚则半身不遂。舌质红苔黄，脉弦。【治法】平肝潜阳（E错），活血通络。（三）气虚血瘀证：【症状】肢体偏枯不用，肢软无力，面色萎黄。舌质淡紫或有瘀斑，苔薄白，脉细涩或细弱。【治法】益气养血，化瘀通络。行气活血（A错）为跌打损伤气滞血瘀证的治法。跌打损伤气滞血瘀证：【症状】患部剧烈疼痛，活动受限，腰部的俯、仰、转侧均感困难，不能挺直，严重者不能站立。若因挫伤引起，则局部肿胀、压痛均较明显。舌质偏暗或有瘀斑，脉弦或紧。【治法】初期宜活血祛瘀，行气止痛；后期宜舒筋活血，补益调治。治法为滋肾利窍（C错）的病证，2022年考试指南未明确说明。